慢性肉芽肿发病的原因是
A. T细胞功能缺陷
B. 联合免疫缺陷
C. B细胞功能缺陷
D. 补体系统缺陷
E. 吞噬细胞功能缺陷

正确答案：E。吞噬细胞功能缺陷